三叉神经的下颌神经通过哪个孔裂
A. 圆孔
B. 卵圆孔
C. 棘孔
D. 眶上裂
E. 无

正确答案：B。卵圆孔

解析：三叉神经的下颌神经通过卵圆孔（B对）出颅。圆孔（A错）为上颌神经出颅的位置。棘孔（C错）为上颌动脉入颅的位置。眶上裂（D错）为眼神经出颅的位置。